碱基置换的后果除外
A. 同义突变
B. 错义突变
C. 无义突变
D. 终止密码突变
E. 染色体畸变

正确答案：E。染色体畸变